男，30岁。全身乏力，面部肌肉紧张2天。7天前田间劳动足部刺伤。局部分泌物标本检出致病微生物为革兰阳性菌，有周鞭毛，无荚膜，厌氧培养呈羽毛状菌落。最可能的致病微生物是
A. 破伤风梭菌
B. 产气荚膜梭菌
C. 铜绿假单胞菌
D. 溶血性链球菌
E. 金黄色葡萄球菌

正确答案：A。破伤风梭菌

解析：30岁男性，全身乏力，面部肌肉紧张2天（破伤风典型症状）；7天前田间劳动足部刺伤（伴有泥土的窄而深伤口形成厌氧微环境）；局部分泌物标本检出致病微生物为革兰阳性菌，有周鞭毛，无荚膜，厌氧培养呈羽毛状菌落（破伤风杆菌菌落典型形态），根据患者既往史、临床症状和实验室结果，最可能的诊断为破伤风，其致病微生物是破伤风杆菌（A对），破伤风杆菌可产生破伤风溶血毒素和破伤风痉挛毒素两种外毒素，后者属于神经毒素，毒性极强，经淋巴、血液循环到达中枢神经系统而致病，典型症状有咀嚼肌痉挛所造成的苦笑貌、牙关紧闭及持续性背部痉挛（角弓反张），还会发生漏口水、出汗和激动，因自主神经系统功能紊乱，还可产生心率不齐、血压波动和因大量出汗造成的脱水。产气荚膜梭菌（B错）革兰染色阳性，无鞭毛，有荚膜，在牛奶培养基中会发生“汹涌发酵”现象；可导致气性坏疽和食物中毒（P134-P135）。铜绿假单胞菌（C错）革兰染色阴性，无芽孢，有荚膜，有鞭毛，可产生带荧光素的水溶性色素（青脓素和绿脓素）；其感染常见于皮肤黏膜受损部位，如烧伤、创伤或手术切口等，表现为局部化脓性炎症（P169-P170）。溶血性链球菌（D错）即乙型溶血性链球菌，革兰染色阳性，无芽胞，无鞭毛，可形成荚膜，菌落周围可形成完全透明的无色溶血环；其致病力强，常引起人类和动物多种疾病（P96）。金黄色葡萄球菌（E错）革兰染色阳性，无芽孢、无鞭毛、一般不形成荚膜，可产生脂溶性色素，致病性葡萄球菌菌落在其周围可见透明溶血环；易于引起侵袭性疾病（化脓性感染）和毒素性疾病（食物中毒等）（P91-P94）。